板状腹见于
A. 急性胆囊炎
B. 急性阑尾炎
C. 急性胃肠穿孔
D. 肠结核
E. 大量腹水

正确答案：C。急性胃肠穿孔

解析：突发而剧烈的刺激，胃酸和胆汁这种化学性的刺激，可引起强烈的腹肌紧张，故急性弥漫性腹膜炎多出现板状腹（C对）。板状腹见于急性胃肠穿孔，突发而剧烈的刺激，胃酸和胆汁这种化学性的刺激，可引起强烈的腹肌紧张。腹壁紧张度增加不见于脱水患者，脱水患者表现为全腹凹陷（D错）。肠胀气是由于多种原因引起的，胃肠道不通畅或梗阻引起胃肠道的气体不能随胃肠蠕动排出体外，气体集聚于胃肠道就会有胀气感，故表现为全腹壁紧张（A错）。病理状态下导致腹腔内液体量增加，超过200mL时称为腹腔积液，故全腹壁紧张见于大量腹水（B错）。结核性炎症腹壁有柔韧感（E错）。